关于生物碱的说法，正确的是
A. 大多具有碱性
B. 大多具有酸性
C. 大多具有生物活性
D. 结构中都含有氮原子
E. 结构中都含有金属原子

正确答案：A、C、D。大多具有碱性；大多具有生物活性；结构中都含有氮原子

解析：本题考查的是生物碱的定义。关于生物碱的说法，正确的是大多具有碱性（A对）、大多具有生物活性（C对）与结构中都含有氮原子（D对）。生物碱是指来源于生物界（主要是植物界）的一类含氮有机化合物。大多数生物碱分子结构中具有复杂的环状结构，且氮原子多位于环内；多具有碱性，可与酸成盐；具有显著的生理活性。大多具有酸性（B错）为鞣质。鞣质为多元酚类生物碱，具有酸性，可与生物碱结合生成难溶于水的沉淀。常作为生物碱色沉淀反应试剂。结构中都含有金属原子（E错）的化合物，2022年考试指南未明确说明。